现代临终关怀事业的创立者是
A. 南丁格尔
B. 乔治
C. 桑德斯
D. 罗纳德
E. 约翰

正确答案：C。桑德斯

解析：桑德斯开创了临终关怀事业。掌握“临终关怀伦理”知识点。